牙槽嵴过度吸收致使义齿的固位差时，可施行
A. 系带矫正术
B. 颌骨重建术
C. 前庭沟加深术
D. 消除有碍的骨突
E. 骨性隆突修整术

正确答案：C。前庭沟加深术

解析：前庭沟加深术：牙槽嵴过度吸收致使义齿的固位差时，可施行前庭沟加深术。该手术通过改变黏膜及肌肉的附着位置（在上颌位置上移，在下颌位置下移），增加牙槽嵴的相对高度，从而增加义齿基托的伸展范围，扩大基托接触面积，达到增强义齿稳定性和固位力的作用。掌握“修复前准备”知识点。